男性，55岁。Graves病史10年，间断治疗，近因合并心律失常被诊断为甲亢性心脏病，其最可能发生的心律失常是
A. 房性早搏
B. 房室交界性早搏
C. 心房颤动
D. 心房扑动
E. 房室传导阻滞

正确答案：A。房性早搏

解析：阵发性或持续性心房纤颤或心房扑动、房室传导阻滞等也可发生。但是以房性早搏最为常见（A对CDE错）。房室交接性早搏的病因与房性期前收缩类似，既可见于正常健康人，也可见于器质性心脏病患者。例如风湿性心脏病、心肌炎、心肌病、冠心病等（B错）。